隐裂牙的主要症状是
A. 牙髓充血
B. 急性牙髓炎
C. 急性根尖炎
D. 慢性牙髓炎
E. 按隐裂部位及程度可能出现上述任一症状

正确答案：E。按隐裂部位及程度可能出现上述任一症状

解析：本题考查牙隐裂的临床表现。隐裂牙不同时期表现不同，早期只累及牙体硬组织，未累及牙髓时，细菌及代谢产物顺着裂缝侵入牙髓激惹牙髓，可引起牙髓充血（A对）。随着裂缝加深，向牙本质延伸，累及牙髓甚至导致牙体的折裂，会出现牙髓炎症状（BD对）。随着裂缝的进一步加深，牙髓炎症加重，继而出现根尖周炎（C对）。（ABCD均对，故E为本题的正确答案）。